瘢痕性幽门梗阻临床表现的叙述，错误的是
A. 呕吐量大，一次可达1000~2000ml
B. 呕吐物多为宿食，有酸臭味，含有胆汁
C. 上腹隆起，可有蠕动波
D. 可有振水音
E. 可有低钾低氯性碱中毒

正确答案：B。呕吐物多为宿食，有酸臭味，含有胆汁

解析：瘢痕性幽门梗阻指由于幽门、幽门管或十二指肠溃疡反复发作形成的瘢痕狭窄，其主要表现为腹痛和反复呕吐，呕吐多发生在下午或晚间，呕吐量大，一次可达1000~2000ml（A对），吐后自觉胃部饱胀改善。幽门梗阻可引起胃排空障碍，使食物蓄积在胃内，胆汁亦不能经梗阻的幽门反流入胃，故呕吐物多为宿食，有酸臭味，不含有胆汁（B错，为本题正确答案）。幽门梗阻时上腹膨隆，梗阻近端扩张，可出现胃的轮廓；若该部位伴有蠕动增强，可看到蠕动波（C对），晃动上腹可闻“振水音”（D对）。幽门梗阻患者由于呕吐丢失大量胃液，可引起低氯性碱中毒；碱中毒后，细胞内钾离子和氢离子交换（H⁺出胞K⁺入胞）增加，可导致细胞外液低钾，综上幽门梗阻可出现低钾低氯性碱中毒（E对）。